患者女，25岁，新婚想半年后要孩子，首选的避孕方法是
A. 皮下埋植避孕
B. 紧急避孕药
C. 宫内节育器
D. 口服避孕药
E. 避孕套

正确答案：E。避孕套

解析：患者为年轻女性，新婚想半年后要孩子，应首选的避孕方法是应采用方便，不影响生育的方法，应首选避孕套（E对）。一般不选用宫内节育器。不适宜应用安全期、体外排精及长效避孕方法（C错）。